骨肉瘤的典型X线表现是
A. 葱皮样骨膜反应
B. 骨质破坏，死骨形成
C. 日光放射状骨膜反应
D. 肥皂泡样骨质反应
E. 干骺端圆形边界清楚的溶骨型病灶

正确答案：C。日光放射状骨膜反应

解析：骨肉瘤的典型X线表现是Codman三角或呈日光放射状骨膜反应（C对）。葱皮样骨膜反应（A错）为尤因肉瘤的典型X线表现。骨质破坏、死骨形成（B错）为慢性骨髓炎的特征性表现。肥皂泡样骨质反应（D错）为骨巨细胞瘤的典型X线表现。干骺端圆形边界清楚的溶骨性病灶（E错）为骨囊肿的X线表现。